持久性有机污染物的特点有
A. 残留时间长
B. 生物蓄积性
C. 高毒性
D. 致畸性
E. A、B和C

正确答案：E。A、B和C

解析：本题考查持久性有机污染物的特点。持久性有机污染物是指能持久存在环境中，并可借助大气，水，生物体等环境介质进行远距离迁移，通过食物链富集，对环境和人类健康造成严重危害的天然或人工合成的有机污染物质。具有以下4个重要特征：持久性、生物蓄积性、迁移性、高毒性（E对ABCD错）。